加间苯三酚试液与盐酸，植物细胞壁显红色，表明该细胞壁
A. 木质化
B. 木栓化
C. 角质化
D. 硅质化
E. 黏液化

正确答案：A。木质化

解析：本题考查的是细胞壁性质检查。间苯三酚试液与盐酸，植物细胞壁显红色，表明该细胞壁木质化（A对）。细胞壁性质检查：木质化细胞壁：加间苯三酚试液1～2滴，稍放置，加盐酸1滴，因木化程度不同，显红色或紫红色。木栓化（B错）或角质化（C错）细胞壁：加苏丹Ⅲ试液，稍放置或微热，呈橘红色至红色。纤维素细胞壁：加氯化锌碘试液，或先加碘试液润湿后，稍放置，再加硫酸溶液（33→50）显蓝色或紫色。硅质化（D错）细胞壁：加硫酸无变化。黏液化（E错）细胞壁的检查方法，2022年考试指南未明确说明。